某市药品监督管理局经群众举报，称某药店贩售假药，而且提供所购买药品。药品监督管理局经确认，该药品为假药的情形。请问该情形是
A. 超过有效期
B. 该药品成分与国家规定的成分不符合
C. 擅自添加着色剂
D. 该药品成分含量与国家规定含量不符合
E. 更改生产批号

正确答案：B。该药品成分与国家规定的成分不符合

解析：假药，是指药品所含成分与国家药品标准规定的成分不符（B对），以及以非药品冒充药品或者以他种药品冒充此种药品的。超过有效期（A错）、擅自添加着色剂（C错）、药品成分含量与国家规定含量不符合（D错）、更改生产批号（E错）指的是劣药。